既退虚热，又清肺热的药是
A. 青蒿
B. 白薇
C. 胡黄连
D. 地骨皮
E. 银柴胡

正确答案：D。地骨皮

解析：本题考查地骨皮的功效。既退虚热，又清肺热的药是地骨皮（D对）。地骨皮【功效】退虚热，凉血，清肺降火，生津。青蒿（A错）【功效】退虚热，凉血，解暑，截疟。白薇（B错）【功效】退虚热，凉血清热，利尿通淋，解毒疗疮。胡黄连（C错）【功效】退虚热，除疳热，清湿热，解热毒。银柴胡（E错）【功效】退虚热，清疳热。